使声襞松弛的肌肉是
A. 环甲肌
B. 甲杓肌
C. 环杓侧肌
D. 环杓后肌
E. 杓斜肌

正确答案：B。甲杓肌

解析：甲杓肌下部肌束，即声带肌收缩使声襞变短并松弛（B对）。